某城市拟建一座钢铁厂，该市常年的主导风向为东南风，根据城市规划卫生学要求，该钢铁厂宜建在城市的
A. 西南
B. 南
C. 东南
D. 东北
E. 西北

正确答案：E。西北

解析：本题考查工业用地的选择。工业用地应按当地主导风向配置在生活居住用地的下风侧，由于该市常年的主导风向为东南风，因此该钢铁厂宜建在城市的西北方（E对ABCD错）。